关于尖锐湿疣不对的是
A. 病原体为人乳头瘤病毒
B. 在分娩经过产道时感染，可引起幼儿喉乳头瘤
C. 若发现病灶广泛在于外阴、阴道和宫颈时，应行择期剖宫产结束分娩
D. 妊娠期尖锐湿疣增多，且生长快，产后进一步加重，应积极治疗
E. 性交为主要传播途径

正确答案：D。妊娠期尖锐湿疣增多，且生长快，产后进一步加重，应积极治疗